一对准父母来妇幼保健院咨询有关孩子出生后进行新生儿疾病筛查的事情。医师的介绍正确的是：目前我国主要筛查的疾病是苯丙酮尿症及
A. 枫糖尿症
B. 21-三体综合征
C. 糖原累积症
D. 肝豆状核变性
E. 先天性甲状腺功能低下症

正确答案：E。先天性甲状腺功能低下症

解析：本题考查新生儿疾病筛查的病种。目前我国新生儿主要筛查的疾病主要是先天性甲状腺功能低下症（E对ABCD错）和苯丙酮尿症两种导致智能发育障碍的疾病，有的地区开展了葡萄糖-6-磷酸脱氢酶缺乏症、先天性肾上腺皮质增生症筛查，部分城市已经开展了串联质谱技术进行遗传代谢病筛查，大大扩大了筛查的疾病谱。新生儿疾病筛查可使患儿出生2～4周内得到确诊。通过后续积极治疗，多数患者预后良好，极大降低了遗传代谢性疾病的危害。